小肠机械性肠梗阻的X线表现
A. 小肠扩张，大量积气积液
B. 两膈下可见新月形透亮气体影
C. 内积气
D. 结肠内可见气体
E. 腹部均致密，腰大肌清晰

正确答案：A。小肠扩张，大量积气积液

解析：小肠机械性肠梗阻的X线表现小肠扩张，大量积气积液。胃肠大量积气可使全腹膨隆，腹部呈球形，两侧腹部膨出不明显，移动体位时腹部形状无明显改变（A对E错）。两膈下可见新月形透亮气体影见于胃肠道穿孔（B错）。肠内积气是功能性的疾病，是胃肠蠕动慢或者脾胃虚弱，容易受凉导致的（CD错）。